医师注册后受吊销医师执业证书行政处罚的
A. 从事医师执业活动
B. 中止医师执业活动
C. 申请执业医师注册
D. 不予医师执业注册
E. 注销执业医师注册

正确答案：E。注销执业医师注册